患儿，男，6岁，发热3天，口腔内黏膜、齿龈溃烂，周围红肿，疼痛拒食，舌质红，苔薄黄。其诊断是
A. 感冒
B. 心疳
C. 口糜
D. 燕口疮
E. 鹅口疮

正确答案：C。口糜

解析：根据患儿“发热3天，口腔内黏膜、齿龈溃烂，周围红肿，疼痛拒食”可诊断为口糜（C对）。感冒（A错）相当于西医的急性上呼吸道感染，是指各种病原体侵犯喉部以上呼吸道的鼻、鼻咽和咽部的急性感染临床以发热、鼻塞、流涕、咽痛或不适为主要症状。心疳（B错）为五疳之一，症见患儿面黄颊赤，眼白中有红丝，壮热，有汗，烦躁，口舌生疮，胸膈烦闷，睡喜伏卧，食欲不振，肌肉消瘦，小便赤涩，或虚惊。燕口疮亦属于疱疹性口炎，但其病损仅在口唇两侧（D错）。鹅口疮（E错）是常见的一种口腔疾病，因患儿口腔及舌上生有白屑或白膜满布，状如鹅口而得名。